牙源性黏液瘤的好发部位
A. 下颌前磨牙和磨牙区
B. 上颌前磨牙和磨牙区
C. 下颌前切牙和尖牙区
D. 上颌前切牙和尖牙区
E. 上颌窦内

正确答案：A。下颌前磨牙和磨牙区

解析：牙源性黏液瘤多发于20～39岁，性别无明显差异，下颌比上颌多见，常位于下颌前磨牙和磨牙区。掌握“牙源性黏液瘤、成牙骨质细胞瘤”知识点。